男，55岁。进行性吞咽困难三个月，体重下降5kg，目前能进半流食。对该病人最可能的诊断是
A. 食管灼伤狭窄
B. 食管癌
C. 食管平滑肌瘤
D. 贲门失弛缓症
E. 食管憩室

正确答案：B。食管癌

解析：中年男性患者，进行性吞咽困难，3个月体重下降5kg（提示恶病质），结合患者病史和临床表现，对该患者最可能的诊断为食管癌（B对）。食管灼伤狭窄（A错）多表现为吞咽困难，不会出现进行性加重。食管平滑肌瘤（C错）可有进食梗咽感，但因其是良性肿瘤，不会在短期内出现体重下降。贲门失弛缓症（D错）主要表现为间断性咽下困难，钡剂造影典型表现为食管下端及贲门部呈鸟嘴状。食管憩室（E错）多无症状，若憩室内有食物残留，可引起颈部压迫感。